关于水银体温计选购和使用注意事项的说法，错误的是
A. 检查水银体温计玻璃泡有无裂纹，以免应用时水银溢出
B. 测量体温以前，应将水银体温计的水银柱甩到35℃以下
C. 幼儿、精神失常者应测量口腔温度
D. 高热昏迷及不能用鼻腔呼吸者，应测量肛门温度
E. 使用水银体温计后，先用冷水冲洗干净，而后浸泡在70%乙醇里

正确答案：C。幼儿、精神失常者应测量口腔温度

解析：本题考查水银体温计选购和使用注意事项。关于水银体温计选购和使用注意事项的说法，错误的是幼儿、精神失常者应测量口腔温度（C错，为本题正确答案）。幼儿、精神失常者都不可测口温，而应测肛温。体温计的选购和使用注意事项：①先检查玻璃泡有无裂纹，以免在应用时水银溢出（A对），引发水银中毒。②测体温前要将水银柱甩到35℃以下（B对）。③幼儿、精神失常、高热神昏及不能用鼻呼吸者都不可测口温，而应测肛温（D对）。④用后须先用冷水冲洗干净，而后浸泡在70%乙醇中备用（E对）。